肱骨干骨折时，最有可能损伤的神经是
A. 腋神经
B. 肌皮神
C. 正中神经
D. 桡神经
E. 无

正确答案：D。桡神经

解析：桡神经（D对）在肱骨中段和桡骨颈处骨折时最易发生损伤。肱骨外科颈骨折、肩关节脱位和使用腋杖不当所致的重压，都有可能造成腋神经（A错）的损伤。肱骨骨折和肩关节损伤时可合并肌皮神经（B错）的损伤。正中神经（C错）极易在前臂和腕部外伤时而损伤。